硫糖铝服后可能导致
A. 黑色大便
B. 口干和视力模糊
C. 便秘
D. 幻觉、定向力障碍
E. 疲乏、嗜睡

正确答案：C。便秘

解析：本题考查硫糖铝的不良反应。硫糖铝属于黏膜保护剂，可用于治疗胃食管反流病，主要的不良反应为便秘（C对），偶见口干、恶心、腹泻等，长期服用可导致低磷血症。